引起医院感染的主要微生物是
A. 细菌
B. 病毒
C. 真菌
D. 衣原体
E. 支原体

正确答案：A。细菌